既属六腑又属奇恒之腑的是
A. 肝
B. 胆
C. 脑
D. 髓
E. 女子胞

正确答案：B。胆

解析：胆居六腑之首，又为奇恒之腑（B对）。胆是中空的囊状器官，内盛胆汁。胆的形态中空、排泄胆汁参与消化，类似六腑，但其内盛“精汁”则又与五脏“藏精”的生理特点相似。可见，胆具备似脏非脏、似腑非腑的特征，故又为奇恒之腑。